在面部，除血供特别丰富的部位外，随意皮瓣长宽之比通常不超过
A. 1：1
B. 1.5:1
C. （2～3）:1
D. （4～5）:1
E. （5～6）:1

正确答案：C。（2～3）:1

解析：随意皮瓣：也称皮肤皮瓣。此类皮瓣的特点是：由于没有知名的血管供血，故在设计皮瓣时，其长宽比例要受到一定限制。在肢体与躯干部位，长宽之比以1.5:1为最安全，最好不超过2:1；在面部，由于血循丰富，根据实际情况可放宽到2～3:1。在血供特别丰富的部位可达4:1。随意皮瓣目前均属近位带蒂转移。掌握“皮瓣移植”知识点。